麻黄炮制的目的是
A. 缓和药性
B. 增强疗效
C. 两者均是
D. 两者均不是

正确答案：A。缓和药性

解析：本题考查的是麻黄的炮制作用。麻黄炮制的目的是缓和药性（A对）。蜜炙法是将净选或切制后的药物，加入定量熟蜜拌炒的方法。蜜炙的主要目的：①增强润肺止咳的作用，如百部、款冬花、紫菀等。②增强补脾益气的作用（B错），如黄芪、甘草、党参等。③缓和药性。如麻黄等。④矫味和消除副作用，如马兜铃等。